药物的稳定化方法有
A. 对不稳定性的成分进行化学结构改造
B. 控制温度与湿度
C. 改变溶剂与pH
D. 液体制剂固体化
E. 提高包装的密封性

正确答案：A、B、C、D、E。对不稳定性的成分进行化学结构改造；控制温度与湿度；改变溶剂与pH；液体制剂固体化；提高包装的密封性

解析：本题考查药物制剂稳定化方法。药物制剂稳定化方法包括：控制温度、调节pH、改变溶剂（C对）、控制水分及湿度（B对）、遮光、驱逐氧气、加入抗氧剂或金属离子络合剂等。稳定化的其他方法：制成固体制剂（D对）、制备稳定的衍生物（A对）、加入干燥剂及改善包装（E对）等。